结构类型为苄基异喹啉衍生物的化学成分是
A. 雷公藤碱
B. 汉防己甲素
C. 阿托品
D. 氧化苦参碱
E. 士的宁

正确答案：B。汉防己甲素

解析：本题考查的是生物碱的分类。结构类型为苄基异喹啉衍生物的化学成分是汉防己甲素（B对）。苄基异喹啉类生物碱：又分为1-苄基异喹啉类和双苄基异喹啉类。①1-苄基异喹啉类：为异喹啉母核1位连有苄基的一类生物碱。如罂粟中具解痉作用的罂粟碱，乌头中的强心成分去甲乌药碱，厚朴中的厚朴碱等。②双苄基异喹啉类：为两个苄基异喹啉通过1～3个醚键相连接的一类生物碱。如存在于防己科北豆根中的主要酚性生物碱蝙蝠葛碱，汉防己中的汉防己甲素和乙素，十大功劳中的异汉防己甲素。雷公藤碱（A错）为雷公藤的主要化学成分之一。雷公藤中主要化学成分为雷公藤甲素、雷公藤乙素和雷公藤红素等。雷公藤中生物碱的基本结构主要分为两类：倍半萜大环内酯生物碱和精眯类生物碱。倍半萜大环内酯生物碱类主要为雷公藤碱、雷公藤次碱、雷公藤宁碱、雷公藤春碱和雷公藤碱己等。精眯类生物碱主要为苯乙烯南蛇碱、呋喃南蛇碱、苯代南蛇碱、南蛇藤别肉桂酰胺碱。莨菪烷类生物碱，此类生物碱多来源于鸟氨酸，由莨菪烷环系的C₃-醇羟基与有机酸缩合成酯。主要存在于茄科的颠茄属、曼陀罗属、莨菪属和天仙子属。重要化合物有莨菪碱（阿托品（C错））、古柯碱等。双稠哌啶类生物碱：由两个哌啶环共用一个氮原子稠合而成的杂环，具喹喏里西啶的基本母核。主要分布于豆科、石松科和千屈菜科。如苦参中的苦参碱、氧化苦参碱（D错），野决明中的金雀花碱等。单萜吲哚类生物碱：结构较复杂，如萝芙木中的利血平、番木鳖中的士的宁（E错）等。